妇女保健工作常用的健康状况指标包括
A. 产前检查率，新法接生率
B. 剖宫产率，会阴侧切率
C. 孕产妇死亡率，围产儿死亡率
D. 受训人员接生率，产后检查率
E. 静脉滴注催产索引产率，产后出血防治率

正确答案：C。孕产妇死亡率，围产儿死亡率

解析：本题考查妇女保健工作常用的健康指标。妇女保健工作常用的健康指标：孕产妇中重度贫血患病率、孕产妇艾滋病病毒感染率、孕产妇梅毒感染率、孕产妇乙肝表面抗原阳性率、孕产妇死亡率、低出生体重儿发生率、围生儿死亡率、新生儿破伤风发病率、出生缺陷发生率等（C对ABDE错）。